患者，女，45岁。两胁胀痛，乳房作胀，头痛目涩，颊赤口干，烦躁易怒，月经不调，少腹作痛，脉弦细而数。治疗应首选
A. 一贯煎
B. 四逆散
C. 逍遥散
D. 黑逍遥散
E. 加味逍遥散

正确答案：E。加味逍遥散

解析：患者两胁胀痛，乳房作胀，月经不调提示肝气郁结；头痛目涩，少腹作痛，为肝血亏虚，不能濡养头目，少腹所致；颊赤口干，烦躁易怒，脉弦细而数是体内有虚热的表现。治疗宜采用加味逍遥散养血健脾，疏肝清热（E对）。一贯煎（A错）的功用为滋阴疏肝。主治：肝肾阴虚，肝气郁滞证。四逆散（B错）的功用为透邪解郁，疏肝理脾。主治：阳郁厥逆证；肝脾不和证。逍遥散（C错）的功用为疏肝解郁，养血健脾。主治：肝郁血虚脾弱证。黑逍遥散（D错）的功用为疏肝健脾，养血调经。主治：肝脾血虚，临经腹痛，脉弦虚。